对磷酸锌粘固剂的描述，不恰当的为
A. 牙髓刺激较大
B. 温度高时凝固快
C. 粉剂中主要是氧化锌
D. 可溶于唾液
E. 凝固后体积膨胀

正确答案：E。凝固后体积膨胀

解析：本题考查磷酸锌水门汀的组成及性能。磷酸锌水门汀在凝固初期有轻微的体积膨胀，2～3小时后发生收缩，以后体积逐渐收缩，而不是凝固后体积膨胀（E错，为本题的正确答案）。磷酸锌粘固剂刚调和时呈酸性，对牙髓刺激性大（A对），凝固后对牙髓的刺激性减小，因此在深龋治疗时不能用磷酸锌粘固剂直接垫底。温度高时能促进磷酸锌粘固剂凝固（B对），充填后口腔中的温度能加速磷酸锌粘固剂的凝固。粉剂中含有75%～90%的氧化锌，氧化锌是粉剂的主要成分（C对）。磷酸锌粘固剂可溶于唾液（D对）过早与水接触会使接触面溶解，因此在充填时严格隔湿，完全凝固后再闭口。